某家庭，父亲及儿子都抽烟，母亲肥胖，从不进行体育锻炼，女儿上大学，在学校居住，每天坚持锻炼，饮食合理。这家女儿具有
A. 日常健康行为
B. A型行为
C. 预警行为
D. C型行为
E. 不良生活方式

正确答案：A。日常健康行为